伤寒患者出现玫瑰疹，多见于
A. 潜伏期
B. 发病初期
C. 高热期
D. 缓解期
E. 恢复期

正确答案：C。高热期

解析：伤寒典型患者临床经过4期，极期即高热期（C对）表现为发热、消化道症状、神经系统症状、相对缓脉、玫瑰疹、肝脾肿大；潜伏期（A错）长短与所摄入的伤寒杆菌的数量、致病性及机体的免疫状态有关，范围为3～42天，一般为7～14天。潜伏期包括四期；发病初期（B错）为病程第1周主要表现为发热恶寒，伴有乏力、头痛、全身不适、食欲不振、腹痛、轻度腹泻等；缓解期（D错）为病程第4周，体温逐渐下降，神经、消化系统等症状好转，脾肿大回缩；恢复期（E错）为病程第5周，临床症状消失。